孕妇HBsAg（+），对其新生儿最好应注射
A. 丙种球蛋白
B. HBIG+乙型肝炎疫苗
C. 干扰素
D. 胎盘球蛋白
E. 乙型肝炎疫苗

正确答案：B。HBIG+乙型肝炎疫苗

解析：对于HBsAg阳性母亲的新生儿，最好在出生后12小时内注射乙型肝炎免疫球蛋白（HBIG）≥100IU，同时在不同部位接种10μg重组酵母或20μgCHO乙型肝炎疫苗，可显著提高阻断母婴传播效果。掌握“乙型肝炎病毒”知识点。